可加重维生素B₁₂缺乏所致营养性巨幼细胞贫血精神症状的是
A. 维生素B₁₂
B. 叶酸
C. 维生素C
D. 铁剂
E. 维生素B₆

正确答案：B。叶酸

解析：本题考查营养性巨幼细胞贫血的相关内容。可加重维生素B₁₂缺乏所致营养性巨幼细胞贫血精神症状的是叶酸（B对ACDE错），缺乏叶酸会导致神经性病变，叶酸是合成细胞核DNA最重要的辅酶，叶酸缺乏的时候，细胞核DNA的复制会出现延迟，病人会出现细胞核发育的迟滞，核浆发育不平衡，会加重维生素B₁₂缺乏所致营养性巨幼细胞贫血精神症状。